慢性肾炎患者，近来少尿、嗜睡，血压170/110mmHg，血BUN40mmol/L，CO2CP12mmol/L，血K+7.4mmol/L，心电图：T波高尖，今日突然抽搐，意识丧失，心跳骤停而死亡，其死亡原因是
A. 代谢性酸中毒
B. 高钾血症
C. 尿毒症脑病
D. 心功不全
E. 脑出血

正确答案：B。高钾血症

解析：因高钾血症常常没有或很少症状而骤然致心脏停搏，应及早发现，及早防治。掌握“急性肾孟肾炎、尿路结石及慢性肾衰竭”知识点。